疫情责任报告人发现乙类传染病病人、病源携带者或疑似传染病病人时，向发病地卫生防疫机构报告传染病，报告的时限为
A. 城镇于3小时内，农村于6小时内
B. 城镇于6小时内，农村于10小时内
C. 城镇于6小时内，农村于12小时内
D. 城镇于6小时内，农村于24小时内
E. 城镇于12小时内，农村于24小时内

正确答案：C。城镇于6小时内，农村于12小时内

解析：本题考查传染病报告制度，乙类传染病要求城镇要求发现后6小时内网络直报，农村不超过12小时（C对）；甲类传染病要求发现后城镇在2小时内报告，农村不超过6小时；丙类传染病要求发现后24小时内报告。